急性经口毒性试验染毒途径常采用
A. 喂饲
B. 灌胃
C. 肌肉注射
D. 腹腔注射
E. 静脉注射

正确答案：B。灌胃